与骨组织亲和力大的药物是
A. 四环素
B. 甲硝唑
C. 螺旋霉素
D. 罗红霉素
E. 环孢素

正确答案：A。四环素

解析：本题考查与骨组织亲和力大的药物。与骨组织亲和力大的药物是四环素（A对），可沉积于新形成的牙齿和骨骼中。甲硝唑（B错）在体内分布广，渗入全身组织和体液，可通过胎盘和血脑屏障，脑脊液中药物也可达有效浓度；主要在肝脏代谢，代谢产物与原形药主要经肾脏排泄，亦可经乳汁排泄。螺旋霉素（C错）属于16元大环内酯类抗生素，是一种很强的抑菌剂，仅在很高的浓度时才呈杀菌作用，具有强大的体内抗菌作用和抗菌后效应（PAE），能够增强吞噬细胞的吞噬作用，广泛分布于体内；本品在组织细胞内浓度较红霉素高，而副作用小于红霉素。罗红霉素（D错）属于第二代半合成大环内酯类抗生素，较其他大环内酯类药物，罗红霉素的血药浓度和细胞内浓度高。环孢素（E错）口服吸收慢而不完全，在血液中约50%被红细胞摄取，30%与血红蛋白结合，4%～9%结合于淋巴细胞，血浆中游离药物仅5%，主要在肝脏代谢，自胆汁排出，有明显的肠肝循环，体内过程有明显的个体差异。